高钾血症
A. 骨骼肌静息膜电位负值增大
B. 骨骼肌静息膜电位负值减少
C. 骨骼肌阈电位上移
D. 骨骼肌阈电位下移
E. 骨骼肌静息膜电位和阈电位负值均减少

正确答案：B。骨骼肌静息膜电位负值减少

解析：高钾血症时由于细胞外液钾浓度增高，细胞内液钾浓度和细胞外液钾浓度的比值变小，静息期细胞内钾外流减少，使Em绝对值减少（B对A错）。高钾血症不会改变阈电位水平（CDE错）。